精子在体内主要贮存在
A. 附睾和输精管
B. 睾丸
C. 前列腺
D. 精囊腺
E. 尿道球腺

正确答案：A。附睾和输精管